结构中含有两个手性碳原子，有四个异构体的药物是
B. 盐酸乙胺丁醇
C. 利巴韦林
D. 齐多夫定
E. 氯霉素

正确答案：E。氯霉素

解析：本题考查药物的化学结构。结构中含有两个手性碳原子，有四个异构体的药物是氯霉素（E对）。左氧氟沙星（A错）结构中含有一个手性碳原子。盐酸乙胺丁醇（B错）结构中含有两个手性碳原子，三个异构体。利巴韦林（C错）结构中含有四个手性碳原子。齐多夫定（D错）结构中无手性碳原子。